既退虚热，又利尿通淋的药是
A. 青蒿
B. 白薇
C. 胡黄连
D. 地骨皮
E. 银柴胡

正确答案：B。白薇

解析：本题考查白薇的功效。既退虚热，又利尿通淋的药是白薇（B对）。白薇【功效】退虚热，凉血清热，利尿通淋，解毒疗疮。青蒿（A错）【功效】退虚热，凉血，解暑，截疟。胡黄连（C错）【功效】退虚热，除疳热，清湿热，解热毒。地骨皮（D错）【功效】退虚热，凉血，清肺降火，生津。银柴胡（E错）【功效】退虚热，清疳热。